与颈总动脉伴行的静脉是
A. 颈内静脉
B. 颈总静脉
C. 颈外动脉
D. 颈前静脉
E. 下颌后静脉

正确答案：A。颈内静脉

解析：颈内静脉（A对）于颈静脉孔处续于乙状窦，在颈动脉鞘内与颈内动脉和颈总动脉伴行。